少腹牵引睾丸坠胀冷痛，其证型是
A. 胆郁痰扰
B. 寒滞肝脉
C. 肝气郁结
D. 肝胆湿热
E. 肝肾阴虚

正确答案：B。寒滞肝脉

解析：寒滞肝脉证，足厥阴肝经绕阴器，循少腹，上巅顶，寒性收引、凝滞，寒袭肝经，阳气被遏，失于温煦，气血运行不畅，经脉收引挛急，故可见少腹牵引睾丸坠胀冷痛（B对）。胆郁痰扰（A错）证候表现为惊悸失眠，胆怯易惊，口苦呕恶，胸胁闷胀，舌红，苔黄腻，脉弦数。肝气郁结（C错）证候表现为胸胁少腹胀满疼痛，走窜不定，善太息，苔薄白，脉弦。肝胆湿热（D错）证候表现为胁肋胀痛，纳呆腹胀，泛恶欲呕，口苦厌油，身目发黄，舌红苔黄腻，脉弦滑数。肝肾阴虚（E错）证候表现为头晕目眩，胸胁隐痛，两目干涩，耳鸣健忘，腰膝酸软，失眠多梦，口燥咽干，五心烦热，舌红少苔，脉细数。